水分可促进微生物繁殖和酶的活动，我国现行植物油质量标准规定，油脂含水量应≤
A. 0.0002
B. 0.001
C. 0.002
D. 0.01
E. 0.02

正确答案：C。0.002

解析：本题考查我国现行植物油质量标准规定的油脂含水量。水分可促进微生物繁殖和酶的活动，我国现行植物油质量标准规定，油脂含水量应≤0.20%（C对ABDE错）。